为规范药品零售环节经营行为，某地药品监督管理部门对辖区内药品零售企业开展监督检查。检查发现：（1）甲药品零售企业涉嫌从非法渠道购进药品，部分批号的阿卡波糖片不能提供购进发票，且经追测码查询，供货单位系某医疗机构：涉嫌违规经营米非司酮片。（2）乙药品零售企业屡次绕开计算机系统销售过期的盐酸二甲双胍缓释片、二甲双胍格列本脲胶囊等药品；计算机系统中有多条超数量销售含麻黄碱类复方制剂的销售记录，其中最多一次销售了50盒，企业留存了本次销售的处方。针对乙违规销售含麻黄碱类复方制剂的行为，下列检查结论错误的是
A. 乙的计算机系统未有效拦截含特殊药品复方制剂超数量销售
B. 乙配备的执业药师未严格履行处方审核职责
C. 乙涉嫌将含麻黄碱类复方制剂流入非法渠道
D. 乙未对违规超量售出含麻黄碱类复方制剂发起药品追回

正确答案：D。乙未对违规超量售出含麻黄碱类复方制剂发起药品追回

解析：本题考查销售含麻黄碱类复方制剂的管理。为规范药品零售环节经营行为，某地药品监督管理部门对辖区内药品零售企业开展监督检查。检查发现：（1）甲药品零售企业涉嫌从非法渠道购进药品，部分批号的阿卡波糖片不能提供购进发票，且经追测码查询，供货单位系某医疗机构：涉嫌违规经营米非司酮片。（2）乙药品零售企业屡次绕开计算机系统销售过期的盐酸二甲双胍缓释片、二甲双胍格列本脲胶囊等药品；计算机系统中有多条超数量销售含麻黄碱类复方制剂的销售记录，其中最多一次销售了50盒，企业留存了本次销售的处方。针对乙违规销售含麻黄碱类复方制剂的行为，下列检查结论错误的是乙未对违规超量售出含麻黄碱类复方制剂发起药品追回（D错，为本题正确答案）。乙药品零售企业留存了本次销售的处方说明乙对违规超量售出含麻黄碱类复方制剂发起药品追回。计算机系统中有多条超数量销售含麻黄碱类复方制剂的销售记录，乙的计算机系统未有效拦截含特殊药品复方制剂超数量销售（A对）。药品零售企业销售含麻黄碱类复方制剂，应当查验购买者的身份证，并对其姓名和身份证号码予以登记。除处方药按处方剂量销售外，一次销售不得超过2个最小包装。乙药品零售企业最多一次销售了50盒，表明乙配备的执业药师未严格履行处方审核职责（B对）且乙涉嫌将含麻黄碱类复方制剂流入非法渠道（C对）。